解救因口服生半夏而引起中毒的措施有
A. 注射苯巴比妥钠
B. 注射阿托品
C. 注射尼可刹米
D. 服用生姜汁
E. 输液

正确答案：C、D、E。注射尼可刹米；服用生姜汁；输液